妊娠剧吐则气阴两亏证的治疗方剂为
A. 香砂六君子汤
B. 橘皮竹茹汤
C. 小半夏加茯苓汤
D. 生脉散合益胃汤
E. 干姜人参半夏丸

正确答案：D。生脉散合益胃汤

解析：妊娠恶阻之气阴两虚主因妊娠呕吐久治不愈，呕吐剧烈，持续日久，导致气阴两虚，治宜益气养阴，和胃止呕，方用生脉散合益胃汤（D对）。妊娠剧吐的痰湿阻滞证选用小半夏加茯苓汤来和胃止呕，引水下行（C错）。香砂六君子汤（A错）为治疗妊娠恶阻之脾胃虚弱证的方药；橘皮竹茹汤（B错）为治疗妊娠恶阻之肝胃不和证的方药；干姜人参半夏丸（E错）主治脾胃不和之妊娠呕吐。